在辅助检查中，不属于临床医生应遵循的道德要求是
A. 从诊治需要出发，目的纯正
B. 认真细致心正无私
C. 知情同意尽职尽责
D. 综合分析切忌片面
E. 密切联系加强协作

正确答案：B。认真细致心正无私

解析：在辅助检查中临床医生应遵循以下伦理要求：（一）诊治需要、目的正当，根据患者的诊治需要、患者的耐受性等综合考虑确定检查项目，对诊治需要且患者又能耐受，即使做多项检查反复检查也是无可指责的，但是简单检查能解决问题就不要做复杂而危险的检查，少数几项检查能说明问题的就不要做更多的检查。为了经济效益驱动而进行的过度检查或者是为了满足科研需要而进行与疾病无关的检查都是不道德的，相反，如果因怕麻烦、图省事，需要的检查项目不做也是一种失职的行为。（二）知情同意、尽职尽责，医生确定了辅助检查的项目以后，一定要向患者和家属讲清楚检查的目的、意义、费用、医疗风险等，让其理解并表示同意后再进行检查，特别是一些比较复杂、费用昂贵或危险性较大的检查更应该得到患者的理解和同意。有些患者对某些检查比如腰穿、骨穿因惧怕痛苦而拒绝检查，只要这些检查是必要的，医生应尽职尽责地向患者进行解释和规劝，以便尽早确定诊断。（三）综合分析、相互协作，为了避免辅助检查的局限性，需要将辅助检查的结果和患者的病史、体格检查的资料一起综合分析，才能做出正确的诊断，切忌片面夸大辅助检查的诊断价值。同时临床医生应当同医技人员相互协作，共同完成对患者的诊断任务。如果出现辅助检查与临床检查不一致的地方，双方应主动协商沟通，通过沟通达成共识，以便更好地作出临床诊断。未提及认真细致心正无私（B错，为本题正确答案）。